属显性感染的是
A. 病原体进入机体后，被非特异性免疫所清除
B. 病原体侵入机体后，仅引起特异性免疫应答，不出现任何临床表现
C. 病原体侵入机体后，既引起特异性免疫应答，又出现相应临床表现
D. 病原体侵入机体后，寄生于机体某些部位，被机体免疫功能局限化，机体免疫功能下降时，可引起相应的临床表现
E. 病原体侵入机体后，不引起相应的临床表现，但机体能排出病原体

正确答案：C。病原体侵入机体后，既引起特异性免疫应答，又出现相应临床表现

解析：显性感染为病原体侵入机体后，既引起特异性免疫应答，又出现相应临床表现（C对）。病原体进入机体后，被非特异性免疫所清除（A错），为病原体清除。病原体侵入机体后，仅引起特异性免疫应答，不出现任何临床表现（B错），为隐性感染。病原体侵入机体后，寄生于机体某些部位，被机体免疫功能局限化，机体免疫功能下降时，可引起相应的临床表现（D错），为潜伏性感染。病原体侵入机体后，不引起相应的临床表现，但机体能排出病原体（E错），为病原携带状态。